有严重肝病的糖尿病患者禁用哪种降血糖药
A. 氯磺丙脲
B. 甲苯磺丁脲
C. 苯乙双胍
D. 胰岛素
E. 二甲双胍

正确答案：A。氯磺丙脲